口腔检查时看不见
A. 腭垂
B. 舌体
C. 牙
D. 舌下阜
E. 腮腺

正确答案：E。腮腺

解析：口腔检查时可见腭垂(A对)，舌体(B对)，牙(C对)，舌下阜(D对)，腮腺(E错，为本题正确答案)全部位于皮肤下面，无法看见。